患者3年来经常心悸，气短。检查：心尖搏动稍向左下移位，心浊音界稍向左下扩大，心尖部听诊可闻及3／6级以上粗糙的收缩期吹风样杂音及舒张期隆隆样杂音。应首先考虑的是
A. 单纯二尖瓣狭窄
B. 单纯二尖瓣关闭不全
C. 二尖瓣狭窄及二尖瓣关闭不全
D. 主动脉瓣狭窄
E. 主动脉瓣关闭不全

正确答案：C。二尖瓣狭窄及二尖瓣关闭不全